男，45岁。乏力、纳差、眼黄、尿黄6天入院。病前2个月外出旅游20多天多在餐馆进餐及进食生冷食物。实验室检查：ALT860U/L，AST620U/L，TBi1260μmol/L，DBi1260μmol/L，PTA85%。如查体发现患者有肝掌，脾大。化验抗HAV-IgM、抗HEV均（-），HBsAg、HBeAg及抗HBc（+），HBV-DNA5.1×10⁶copies/mL。应诊断为
A. HBsAg携带者
B. 肝衰竭乙型
C. HBV携带者
D. 急性乙型肝炎
E. 慢性乙型肝炎

正确答案：D。急性乙型肝炎

解析：中年男性患者，乏力、纳差、眼黄、尿黄6天入院。病前2个月外出旅游20多天多在餐馆进餐及进食生冷食物。实验室检查：ALT860U/L，AST620U/L，TBil260μmol/L（总胆红素，正常值3.4-17.1µmol/L），DBil260μmol/L（直接胆红素，正常值0-6.8µmol/L），PTA85%（凝血酶原活动度，正常值75％-100％）。查体发现患者有肝掌（肝功能减退的表现），脾大（肝硬化门静脉高压的表现）。化验抗HAV-IgM、抗HEV均（-），HBsAg、HBeAg及抗HBc（+），HBV-DNA5.1×l0⁶copies/mL（乙肝病毒基因，正常值＜1×l0³copies/mL）。综合患者的症状、体征和辅助检查，初步诊断为应诊断为急性乙型肝炎（D对）。HBsAg携带者（A错）的肝脏没有炎症，肝功能的各项检查均正常。肝衰竭乙型（B错）表现为2周内出现2度及以上肝性脑病。HBV携带者（C错）很少有肝病相关的症状与体征，肝功能基本正常。慢性乙型肝炎（E错）病程超过半年。